以下不符合乳牙的髓腔形态特征的是
A. 髓室大
B. 髓壁薄
C. 髓角高
D. 根管粗
E. 根尖孔较小

正确答案：E。根尖孔较小

解析：本题考查乳牙髓腔的形态特点。根尖孔较小（E错，为本题正确答案）不符合乳牙的髓腔形态特点。髓腔较恒牙大，根尖孔亦较大。乳牙髓腔较恒牙者为大，表现为髓室大（A对）、髓壁薄（B对）、髓角高（C对）、根管粗（D对）、根管斜度较大，根尖孔亦大。